粒细胞缺乏症可出现的临床表现是
A. 进行性贫血
B. 皮肤、鼻腔等处发生坏死性溃疡
C. 皮肤、黏膜出血
D. 频繁性呕吐
E. 胸骨压痛

正确答案：B。皮肤、鼻腔等处发生坏死性溃疡

解析：粒细胞缺乏症可出现的临床表现是高热、皮肤、鼻腔等处发生坏死性溃疡（B对）及严重的败血症、脓毒血症或感染性休克等。进行性贫血见于慢性失血或溶血、白血病等（A错）。皮肤、黏膜出血见于血小板减少（C错）。频繁性呕吐见于胃肠道疾病或颅内高压（D错）。胸骨压痛见于白血病等（E错）。